关于伊托必利的描述，错误的是
A. 具有多巴胺D₂受体拮抗作用，可增加乙酰胆碱释放
B. 具有乙酰胆碱酯酶抑制作用，阻止乙酰胆碱水解
C. 几乎无甲氧氯普胺的锥体外系副作用
D. 易通过血-脑屏障而产生中枢副作用
E. 几乎无西沙必利的致室性心律失常副作用

正确答案：D。易通过血-脑屏障而产生中枢副作用

解析：本题考查伊托必利的作用特点。伊托必利在中枢神经系统分布少，选择性高，不良反应少（D错，为本题正确答案）。伊托必利具有多巴胺D₂受体拮抗作用，能够增加乙酰胆碱的释放（A对），同时通过对乙酰胆碱酯酶的抑制作用来抑制已释放的乙酰胆碱分解（B对）。不产生甲氧氯普胺的锥体外系症状（C对），无西沙必利的致室性心律失常副作用（E对）。